下列穴位定位错误的是
A. 球后穴在眶下缘外1/3与内2/3交界处
B. 夹承浆在承浆穴旁开1寸
C. 牵正穴在耳垂前0. 5〜1寸处
D. 颈臂穴在锁骨内1/3与外2/3交界处直上1寸
E. 安眠穴在翳风穴与风池穴连线的中点

正确答案：A。球后穴在眶下缘外1/3与内2/3交界处

解析：球后穴在眶下缘外1/4与内3/4交界处（A对）。夹承浆在承浆穴旁开1寸（B错）。牵正穴在耳垂前0. 5〜1寸处（C错）。颈臂穴在锁骨内1/3与外2/3交界处直上1寸（D错）。安眠穴在翳风穴与风池穴连线的中点（E错）。